属于食源性疾病被动监测的形式是
A. 检查医学记录
B. 医生按既定的报告规范向卫生行政部门报告
C. 筛选高危人群
D. 访谈食源性疾病暴发调查的个体
E. 检查实验室记录

正确答案：B。医生按既定的报告规范向卫生行政部门报告

解析：本题考查食源性疾病被动监测的形式。食源性疾病监测分为主动监测和被动监测两类。主动监测是公共卫生人员定期到医院、疾病预防控制中心、药店、学校等责任报告单位主动收集特定疾病发生情况的监测方式。在主动监测过程中，一般采取直接采集信息的形式，即通过检查医学记录（A错）、实验室记录（E错）、访谈食源性疾病暴发调查中的个体（D错）或筛选高危人群（C错）等形式实现。被动监测是由责任报告人（如医务人员、食源性疾病暴发或发生单位等）按照既定的报告规范和程序向卫生行政部门、疾病预防控制中心和食品药品监管部门等机构常规地报告疾病数据和信息（B对），而报告接收单位被动接受报告的监测方式。